悬空式桥体龈面与黏膜之间留有至少3mm以上的间隙，主要是因为
A. 便于食物易通过，有自洁作用
B. 不刺激和压迫牙龈组织
C. 制作简单
D. 患者感觉舒适
E. 便于食物对牙龈按摩

正确答案：A。便于食物易通过，有自洁作用

解析：本题考查悬空式桥体。悬空式桥体又称为卫生桥，主要用于失牙区牙槽嵴缺损较大的后牙缺失修复，此种设计主要目的是为了便于食物通过，有自洁作用（A对）。在悬空式桥体制作简单（C错），食物通过时对牙龈有按摩作用（E错），不会刺激和压迫牙龈（B错），但这些都不是主要原因。悬空式桥体与天然牙的形态差异大，美观性差，患者感觉不适（D错）。